肝功能不全时，使用经肝脏代谢后活化的药物（如可的松），可出现
A. 作用增强
B. 作用减弱
C. t1/2延长，作用增强
D. t1/2缩短，作用减弱
E. 游离药物浓度下降

正确答案：B。作用减弱

解析：本题考查肾上腺糖皮质激素药。肝功能不全时，经肝脏代谢后活化的药物如可的松作用减弱（B对A错）。因为发挥药效的是可的松经过肝脏代谢生成的代谢物氢化可的松。肝功能不足时，代谢生成的有效药物减少，游离药物浓度增加（E错）。药物消除半衰期是血浆浓度下降一半所需要的时间，药物的半衰期主要决定于药物的性质，此题无法推断半衰期的变化（CD错）。